戴全口义齿静止时固位好，吃饭时脱位，怎样处理
A. 加强基托后缘封闭
B. 重新制作
C. 调（牙合）选磨
D. 基托衬垫
E. 加高垂直距离

正确答案：C。调（牙合）选磨

解析：固位尚好，但在咀嚼食物时，义齿容易脱位，是由于（牙合）不平衡，牙尖有干扰，使义齿翘动，破坏边缘封闭造成的。在下颌磨牙后垫部位基托伸展过长，与上颌结节后缘基托相接触或接近，或上颌（牙合）平面较低，当下颌向前伸时，上下颌基托后缘相接触，使下颌义齿前部翘起，也可影响义齿固位，修改时应进行选磨调（牙合），消除牙齿过早接触和牙尖的干扰，或将基托边缘磨短或磨薄。掌握“全口义齿戴入后问题及处理”知识点。